不稳定型心绞痛与急性非ST段抬高型心肌梗死的鉴别
A. 心电图
B. ST段抬高
C. 冠状动脉造影
D. 持续时间
E. 肌钙蛋白

正确答案：E。肌钙蛋白

解析：在NSTEMI 的诊断中，症状发生后的24小时内，cTn的峰值超过正常对照值的 99 个百分位，而在不稳定型心绞痛（UA）中，它的诊断主要是依靠临床表现以及发作时心电图 ST-T 的动态改变，如果cTn 阳性意味该病人已发生少量心肌损伤，预后较cTn 阴性病人的预后较差，故肌钙蛋白可用于不稳定型心绞痛与急性非st段抬高型心肌梗死的鉴别(E对ABCD错)。